腹痛腹泻黏液脓血便，伴发热恶寒，最可能的诊断是
A. 细菌性痢疾
B. 阿米巴痢疾
C. 急性胃肠炎
D. 流行性脑脊髓炎
E. 霍乱

正确答案：A。细菌性痢疾

解析：细菌性痢疾简称菌痢，是由志贺菌也称痢疾杆菌引起的肠道传染病。以腹痛、腹泻、排黏液脓血便、里急后重等为主要表现，严重者可出现感染性休克和（或）中毒性脑病（A对）。阿米巴痢疾多不发热，少有毒血症状，腹痛轻，无里急后重，腹泻每日数次，多为右下腹压痛（B错）。急性胃肠炎主要表现为腹痛、腹泻、恶心和呕吐等症状（C错）。流行性脑脊髓膜炎主要临床表现是突发高热、剧烈头痛、频繁呕吐，皮肤黏膜瘀点、瘀斑及脑膜刺激征，严重者可有败血症休克和脑实质损害，常可危及生命。部分患者暴发起病，可迅速致死（D错）。霍乱是由霍乱弧菌引起的一种烈性肠道传染病。典型病例以剧烈水样腹泻为主要症状，可在短时间内引起脱水、电解质平衡紊乱、代谢性酸中毒，严重者可迅速发展为循环衰竭、肾衰竭，并可导致死亡（E错）。